颈丛的说法中,何者错误
A. 由全部颈神经前支组成
B. 由1-4颈神经前支组成
C. 位于胸锁乳突肌上部的深面
D. 发出的皮支经胸锁乳突肌后缘中点穿出
E. 发出膈神经

正确答案：A。由全部颈神经前支组成

解析：颈丛由第1~4颈神经前支相互交织构成（B对A错，为本题正确选项），位于胸锁乳突肌上部的深面（C对）。颈丛的皮支在胸锁乳突肌深面集中后，从该肌后缘中点附近浅出（D对），然后散开行向各方，分布于一侧颈部皮肤。发出枕小神经、耳大神经、颈横神经、锁骨上神经和膈神经（E对）。